心动周期中，主动脉压的最高值
A. 舒张压
B. 循环系统平均充盈压
C. 平均动脉压
D. 收缩压
E. 脉压

正确答案：D。收缩压

解析：心动周期中，心室收缩期中期达到最高值时的血压，即主动脉压的最高值，称为收缩压（D对）。舒张压（A错）是指心室舒张末期动脉血压达最低值时的血压。循环系统平均充盈压（B错）可用来表示循环系统中血液的充盈程度。平均动脉压（C错）则为一个心动周期中每一瞬间动脉血压的平均值。脉搏压（简称脉压）（E错）是指收缩压和舒张压的差值。